关于完全脱位牙的叙述正确的是
A. 在1小时内进行再植，90%可避免发生牙根吸收
B. 脱位在2小时以后再就诊，牙周膜有可能重建
C. 年轻完全脱位的恒牙，若拖延就诊时间，也可以获得较好预后
D. 根尖发育完全的脱位牙，及时复位3～4周后再进行根管治疗术
E. 被污染的完全脱位牙，可以进行干藏

正确答案：D。根尖发育完全的脱位牙，及时复位3～4周后再进行根管治疗术

解析：完全脱位牙在0.5小时内进行再植，90%患牙的可避免发生牙根吸收。如牙齿已落地污染，不能即刻复位，可将患牙置于患者的舌下或口腔前庭处，也可放在盛有牛奶、生理盐水或自来水的杯子内，切忌干藏。根尖发育完成的脱位牙，若就诊迅速或复位及时，应在术后3～4周再做根管治疗术。如果脱位在2小时以后再就诊者，牙髓和牙周膜内细胞已坏死，不可能期望牙周膜重建。年轻恒牙完全脱位，若就诊迅速或自行复位及时者，牙髓常能继续生存，不要贸然拔髓，一般疗效是良好的。掌握“牙脱位”知识点。